患儿3岁，胆小腼腆。前牙开（牙合），有散在间隙。此患儿有吮指不良习惯。现阶段较好的处理是
A. 不做处理，观察
B. 手指涂抹药物以去除不良习惯
C. 固定矫治器矫治
D. 采取合适的护理和心理疏导方法
E. 严厉管教，杜绝不良习惯

正确答案：B。手指涂抹药物以去除不良习惯

解析：本题考查吮指习惯的防治方法。患儿有吮指不良习惯。现阶段较好的处理是手指涂抹药物以去除不良习惯（B对）。儿童吮吸活动不足、过早断奶、无意识动作或缺乏与家人的情感交流，可养成吮指的不良习惯，严厉管教的出发点是好的，但不利于儿童心理的正常发育（E错）。吮指持续到3岁以后，会出现牙列或骨的改变，可造成明显牙面部畸形（AD错），可在习惯性吮吸的手指上涂抹一些对身体无害的苦味剂来防治。早期矫治最好在4岁（C错）左右进行。